我国《职业病防治法》的立法宗旨是
A. 预防和消除职业病危害，保护劳动者健康及其相关权益
B. 预防和控制职业病危害，防治职业病
C. 保护劳动者健康及其相关权益，促进经济发展
D. 防治职业病，促进经济发展，保护劳动者健康及其相关权益
E. 预防、控制和消除职业病危害，防治职业病，保护劳动者健康及其相关权益，促进经济发展

正确答案：E。预防、控制和消除职业病危害，防治职业病，保护劳动者健康及其相关权益，促进经济发展